流行病学队列研究中由于失访导致的偏倚是
A. 选择偏倚
B. 调查者偏倚
C. 混杂偏倚
D. 测量偏倚
E. 回忆偏倚

正确答案：A。选择偏倚